胃肠平滑肌动作电位除极相形成的离子基础是
A. Na⁺内流
B. Ca²⁺内流
C. K⁺内流
D. K⁺外流
E. Cl⁻内流

正确答案：B。Ca²⁺内流